以下关于混合性腺泡的叙述，不正确的是
A. 黏液细胞紧接闰管
B. 浆液细胞呈新月状覆盖于腺泡的盲端表面
C. 能形成半月板的结构
D. 胞质内无黏原颗粒
E. 由黏液细胞和浆液细胞组成

正确答案：D。胞质内无黏原颗粒

解析：混合性腺泡由黏液细胞和浆液细胞组成。前者组成腺泡之大部分，紧接闰管；后者呈新月状覆盖于腺泡的盲端表面，又名半月板。浆液细胞的分泌物有细胞间小管通入腺泡腔内。掌握“唾液腺组织结构”知识点。